肺分肺实质和肺间质两部分。肺实质即肺内支气管的各级分支及其终末的大量肺泡，肺间质即肺内的结缔组织及血管、淋巴管和神经。肺的实质是指
A. 小支气管各级分支和肺泡
B. 支气管各级分支和肺泡
C. 肺内小支气管各级分支和肺泡
D. 肺内支气管树和肺泡
E. 肺内细支气管和肺泡

正确答案：D。肺内支气管树和肺泡

解析：肺的实质是指肺内支气管树和肺泡（D对）。